泪腺
A. 位于眶上壁内侧部的泪腺窝内
B. 泪腺的分泌液中有溶菌酶
C. 有排泄管开口于结膜上穹的内侧部
D. 最情况多见泪液自脸裂流出
E. 无

正确答案：B。泪腺的分泌液中有溶菌酶

解析：泪腺位于眼眶外上方的泪腺窝内，而非眶上壁内侧部（A错）。泪腺的分泌液中有溶菌酶（B对），对细菌有杀伤作用。泪腺的排泄管开口于结膜上穹的外侧部，而非结膜上穹的内侧部（C错）。一般情况，多余的泪液经鼻泪管至鼻腔，而非自脸裂流出（D错）。